具有行气散结，降逆化痰功用的方剂是
A. 定喘汤
B. 瓜蒌薤白白酒汤
C. 半夏厚朴汤
D. 苏子降气汤
E. 柴胡疏肝散

正确答案：C。半夏厚朴汤

解析：本题考查半夏厚朴汤的功效。其具有行气散结，降逆化痰（C对）的功效，用于主治梅核气。定喘汤具有宣降肺气，清热化痰的功效（A错）。瓜蒌薤白白酒汤具有通阳散结， 行气祛痰的功效（B错）。苏子降气汤具有降气平喘，祛痰止咳的功效（D对）。柴胡疏肝散具有疏肝行气，活血止痛的功效（E错）。